下列有关无菌创口处理原则的说法不正确的是
A. 无菌创口若无组织缺损，则不用进行严密缝合
B. 有组织缺损者可采取皮瓣转移和植皮的方法
C. 术后有可能发生感染的创口，应放置24～48小时的引流物
D. 疑有污染或术后渗血较多的创口，也应放置24～48小时的引流物
E. 无效腔过大的创口，应延长引流时间至72小时以上

正确答案：A。无菌创口若无组织缺损，则不用进行严密缝合

解析：本题考查无菌创口的处理原则。下列有关无菌创口处理原则的说法不正确的是无菌创口若无组织缺损，则不用进行严密缝合（A错，为本题正确答案）。无菌创口不论有无组织缺损，均应争取作整齐与严密的缝合。有组织缺损者，可采取皮瓣转移和植皮的方法（B对）解决。对术后有可能发生感染、疑有污染或术后渗血较多的创口，应放置24～48小时的引流物（CD对）。如死腔过大或渗出物较多，应延长引流时间至72小时以上（E对）。无菌创口除为拔除引流物及怀疑已有感染者外，一般不轻易打开敷料观察。面部严密缝合的创口可早期暴露，并及时以过氧化氢和硼酸及乙醇混合液清除渗出物。面部的无菌创口一般可早期拆线，张力过大或有手术特殊要求者除外，由于面部血液循环丰富，生长力强，可在术后5天开始拆线；颈部缝线可在术后7天左右拆除；光刀手术的创口，拆线时间应推迟至术后14天。